牛蒡子除疏散风热外，又能
A. 明目退翳
B. 清肺润燥
C. 除湿止痛
D. 解毒透疹
E. 祛风止痛

正确答案：D。解毒透疹

解析：本题考查牛蒡子的功效。牛蒡子除疏散风热外，又能解毒透疹（D对）。牛蒡子【功效】疏散风热，宣肺利咽，解毒透疹，消肿疗疮。木贼【功效】疏散风热，明目退翳（A错），止血。天冬【功效】滋阴降火，清肺润燥（B错），润肠通便。苍耳子【功效】散风寒，通鼻窍，除湿止痛（C错），止痒。蔓荆子【功效】疏散风热，清利头目，祛风止痛（E错）。